哮病发生的“夙根”是
A. 风
B. 痰
C. 气
D. 虚
E. 瘀

正确答案：B。痰

解析：哮病发生多因宿痰内伏于肺，由外邪侵袭、饮食不当、体虚病后等诱因引触，以致痰随气升，气因痰阻，相互搏结，痰阻气道，肺气宣降失常，气道挛急狭窄，通畅不利，而致痰鸣如吼，咳痰喘促，故哮病发生的"夙根"是痰（B对）。而风（A错）、气（C错）、虚（D错）、瘀（E错）皆为发病的诱因。